百日咳咳嗽的特点为
A. 咳声清扬，伴流清涕
B. 呛咳连声，有鸡鸣样吼声
C. 咳声重浊，痰稠色黄
D. 咳声嘶哑，如犬吠样
E. 干咳无痰，口鼻干燥

正确答案：B。呛咳连声，有鸡鸣样吼声

解析：百日咳咳呈阵发，连续不断，咳止时常有鸡鸣样回声（B对）。咳声清扬，伴流清涕多属风寒咳嗽（A错）。咳声重浊，痰稠色黄多属风热咳嗽（C错）。咳声嘶哑，如犬吠样多见于白喉（D错）。干咳无痰，口鼻干燥多属燥邪犯肺或阴虚肺燥所致（E错）。